不属于镇肝熄风汤组成药物的是.
A. 赭石牛膝
B. 龙骨牡蛎
C. 当归麦冬
D. 茵陈麦芽
E. 生龟板生杭芍

正确答案：C。当归麦冬

解析：镇肝熄风汤方含怀牛膝、生赭石、生龙骨、生牡蛎、生龟板、生杭芍、玄参（滋阴清热）、天冬（滋阴）、川楝子（疏肝理气）、生麦芽、茵陈、甘草，以镇肝息风，滋阴潜阳，主治肝肾阴虚，肝阳偏亢，阳亢化风，气血逆乱之类中风。（C错，为本题正确答案）。